桔梗除祛痰排脓外，又能
A. 消肿散结
B. 宣散风热
C. 平肝镇惊
D. 清心定惊
E. 开宣肺气

正确答案：E。开宣肺气

解析：本题考查桔梗的功效。桔梗除祛痰排脓外，又能开宣肺气（E对）。桔梗【功效】宣肺，利咽，祛痰，排脓。浙贝母【功效】清热化痰，散结消肿（A错）。前胡【功效】降气祛痰，宣散风热（B错）。礞石【功效】消痰下气，平肝镇惊（C错）。天竺黄【功效】清热化痰，清心定惊（D错）。